—般头皮裂伤清创的时限不应超过
A. 24小时
B. 72小时
C. 8小时
D. 48小时
E. 12小时

正确答案：A。24小时

解析：一般伤口清创的最佳时限为伤后6～8小时内，但在头皮，由于血供丰富，抗感染能力强，其一期缝合时限可适当放宽，但不应超过24小时（A对）。